诊断胆囊结石首选的检查方法
A. 腹部X线平片
B. B超
C. 口服胆囊造影
D. CT
E. MRI

正确答案：B。B超

解析：B超（B对）可以发现结石，并明确其大小和部位，操作简单，价格低廉，对结石的诊断准确率接近100%，是诊断胆囊结石首选的检查方法。腹部x线平片（A错）仅能显示含钙量超过10%的结石，这部分结石患者仅占10%～15%。口服法胆囊造影（C错）是测定胆囊浓缩功能的方法，主要于诊断胆囊炎，而非诊断胆囊结石。CT（D错）、MRI（E错）可显示胆囊结石，但价格昂贵，操作复杂，故其不能作为胆囊结石的首选检查。